低渗性脱水早期尿量和渗透压的变化是
A. 尿量减少，渗透压增加
B. 尿量增加，渗透压下降低
C. 尿量增加，渗透压下增高
D. 尿量减少，渗透压降低
E. 尿量不减少，渗透压减少

正确答案：E。尿量不减少，渗透压减少

解析：低渗性脱水时失钠多于失水，细胞外液渗透压降低（AC错）。血浆渗透压降低使抗利尿激素分泌减少，故早期尿量无明显减少（E对）。但在晚期血容量显著降低时，ADH释放增多，肾小管对水的重吸收增加，可出现少尿。